由肾实质性因素导致的急性肾衰中，最常见的类型是
A. 急性肾炎
B. 急进性肾炎
C. 急性肾小管坏死
D. 急性间质性肾炎
E. 多发性小血管炎

正确答案：C。急性肾小管坏死

解析：肾性AKI 引起肾性AKI的病因众多，可累及肾单位和间质任何部位。以肾缺血和肾毒性物质导致肾小管上皮细胞损伤，即急性肾小管坏死（C对）最为常见，其他还包括急性间质性肾炎（D错）、肾小球疾病（包括肾脏微血管疾病）（AB错）、血管疾病（E错）和肾移植排斥反应等五大类。